地高辛对哪种心衰的疗效最好
A. 肺源性心脏病引起
B. 严重二尖瓣狭窄引起的
C. 甲状腺机能亢进引起的
D. 严重贫血引起的
E. 心房纤颤伴心室率快引起的

正确答案：E。心房纤颤伴心室率快引起的

解析：不同原因所致的心力衰竭因病情不同，其疗效有一定的差异地高辛：对有心房纤颤伴心室率快的心力衰竭疗效最佳；对瓣膜病、风湿性心脏病（高度二尖瓣狭窄的病例除外）、冠状动脉粥样硬化性心脏病和高血压性心脏病所导致的心功能不全疗效较好；对肺源性心脏病、活动性心肌炎（如风湿活动期）或严重心肌损伤，疗效也较差，且容易发生中毒；对扩张性心肌病，心肌肥厚、舒张性心力衰竭者不应选用强心苷，而应首选β受体阻断药、ACE抑制药。掌握“强心苷、ACE抑制剂”知识点。